某厂“因设备故障致一氧化碳外逸，维修工赵某在处理故障时吸入大量一氧化碳倒地昏迷，被人送医院抢救。查体：呈急性重病容，神志不清，呼吸急促，口吐白沫，查体不合作，瞳孔等大，对光反应迟钝。口唇明显发绀，两肺呼吸音粗糙，颈有抵抗，四肢瘫软，生理反射消失，巴宾斯基征（﹢）。白细胞数偏高，血钾、钠、氯、二氧化碳结合力偏低；尿蛋白（﹢﹢）。心电图示右心肌受损。最有效的治疗措施是及时
A. 大剂量给氧
B. 抗休克
C. 纠正酸中毒、电解质紊乱
D. 抗感染
E. 输血补液

正确答案：A。大剂量给氧